汗腺排出的氟约占
A. 5%～8%
B. 6%～9%
C. 7%～10%
D. 8%～11%
E. 9%～12%

正确答案：C。7%～10%

解析：机体还可通过其他途径排出部分氟，粪便排出12.6%～19.5%的氟，汗腺排出的氟约占7%～10%。还有微量的氟可由泪液、头发、指甲排出。掌握“人体氟摄入及代谢、氟防龋”知识点。